知母不宜用于
A. 肠燥便秘者
B. 骨蒸潮热者
C. 脾虚便溏者
D. 肺热咳嗽者
E. 内热消渴者

正确答案：C。脾虚便溏者

解析：知母性寒质润，有滑肠作用，故脾虚便溏者（C错，为本题正确答案）慎用。知母功效是清热泻火，滋阴润燥；因能滋阴润燥以通便，可用于治阴虚肠燥便秘（A对）。因入肾经，能滋肾阴、泻肾火、退骨蒸，可用于治肾阴亏虚，阴虚火旺之骨蒸潮热（B对）。因入肺经，苦寒能清肺热，甘寒能滋肺阴、润肺燥，可用于治肺热咳嗽（D对）。因苦甘寒质润，取其清热泻火、滋阴润燥、生津止渴之功，常用治内热津伤，口渴引饮之消渴证（E对）。